女，30岁，阴道不规则流血20天，咳嗽5天。半年前行人工流产，吸出物见到绒毛组织，妇科检查：子宫如40天妊娠大小，质软，双侧附件区均可触及大小约5cm的囊性包块，胸部X线片示双侧中下野多发棉球状阴影。主要的治疗方式是
A. 药物流产
B. 保胎治疗
C. 手术治疗
D. 放射治疗
E. 化学治疗

正确答案：E。化学治疗

解析：女性患者，半年前行人工流产，吸出物见到绒毛组织（正常妊娠），现阴道不规则流血，双侧附件区均可触及大小约5cm的囊性包块（卵巢黄素化囊肿）。患者咳嗽，胸部X线片示双侧中下野多发棉球状阴影（提示肺转移）。据患者病史、临床表现及妇科检查，最可能的诊断为 1.绒癌（A对）；2.转移性肺癌。治疗原则为采用以化疗（E对）为主、手术和放疗为辅的综合治疗。